早期浸润性宫颈癌是指宫颈上皮癌变，癌组织
A. 达基底膜
B. 已延伸至宫颈腺体
C. 累及宫体内膜腺体
D. 穿透基底膜，深度＜5mm
E. 累及腺体穿透基底膜至浅肌层

正确答案：D。穿透基底膜，深度＜5mm

解析：子宫颈鳞状细胞癌依据进展过程，可分为早期浸润癌和浸润癌，早期浸润性宫颈癌指宫颈上皮癌变，癌组织穿透基底膜，浸润深度＜5mm（D对）者；浸润癌指癌组织浸润深度超过基底膜下5㎜者，故癌组织穿透基底膜至浅肌层（E错）属于浸润癌。异型增生的细胞累及子宫颈粘膜全层，但未突破基底膜（A错）为宫颈原位癌（P285）；癌细胞蔓延至子宫颈腺体内，未突破基底膜称为原位癌累及腺体，仍属于原位癌的范畴（B错）。宫颈癌的癌组织向上浸润破坏整段子宫颈，但很少侵犯子宫体（P287）（B错）。